反映药物量效变化速度的是
A. 效能
B. 效价强度
C. 治疗指数
D. 药物量效曲线
E. 曲线的斜率

正确答案：E。曲线的斜率

解析：斜率：量-效曲线中段（50%Emax）的曲线坡度。斜率越大，说明药物剂量的微小变化即可引起效应的明显改变，提示药效较剧烈；斜率越小，提示药效相对较温和（E对）。效能是指药物所能产生的最大效应（A错）。效价强度指药物达到一定效应时所需的剂量（B错）。治疗指数是LD₅₀/ED₅₀的比值，药物的安全性指标（C错）。以药物效应强度为纵坐标，药物剂量或浓度为横坐标，得到的曲线即量效曲线，分为量反应量效曲线和质反应量效曲线（D错）。